不属于B型行为的是
A. 容易满足
B. 悠然自得
C. 随遇而安
D. 有时间紧迫感
E. 无竞争敌对倾向

正确答案：D。有时间紧迫感

解析：A型行为的特点：争强好胜，雄心勃勃，积极工作，而又急躁易怒，即具有时间紧迫感和竞争敌对倾向等特征。相反悠然自得，容易满足，随遇而安，无时间紧迫感，不争强好胜属B型行为类型。掌握“心身疾病”知识点。